小儿暑温的三大主症是
A. 高热、头痛、抽搐
B. 高热、昏迷、抽搐
C. 高热、呕吐、抽搐
D. 高热、呕吐、昏迷
E. 高热、头痛、昏迷

正确答案：B。高热、昏迷、抽搐

解析：流行性乙型脑炎属于小儿暑温，以高热、抽搐、昏迷为特征（B对）。（ACDE错）。